正常人每天可生成胆红素
A. 100～200mg
B. 150～250mg
C. 200～300mg
D. 250～350mg
E. 300～400mg

正确答案：D。250～350mg

解析：正常人每天可生成250～350mg胆红素，其中约80%以上来自衰老红细胞破坏所释放的血红蛋白的分解。血红蛋白随后分解为珠蛋白和血红素。珠蛋白可降解为氨基酸供体内再利用。血红素则由单核吞噬系统细胞降解生成胆红素。掌握“胆色素代谢”知识点。